重型霍乱患者治疗的关键是
A. 大量口服补液
B. 有效抗菌治疗
C. 短期应用糖皮质激素
D. 禁食
E. 快速静脉补液

正确答案：E。快速静脉补液

解析：对重型霍乱脱水的治疗关键是快速静脉补液（E对），静脉补液适于重度脱水、不能口服的中度脱水及极少数轻度脱水患者，补液原则是早期、迅速、足量，先盐后糖，先快后慢，纠酸补钙，见尿补钾。大量口服补液（A错）适用于轻、中度脱水患者，重度脱水患者在纠正低血容量性休克后才可口服补液；有效抗菌治疗（B错）、短期应用糖皮质激素（C错）为辅助治疗，能减少腹泻量，并可缩短泻吐期及排菌期，但不能替代补液措施；呕吐不一定是口服补液的禁忌，不必禁食（D错）。